患者女。因流产而失血过多，导致月经不调，久不怀孕。其病在哪经
A. 阴跷脉、阳跷脉
B. 阴维脉、阳维脉
C. 督脉、任脉
D. 冲脉、任脉
E. 阴跷脉、阴维脉

正确答案：D。冲脉、任脉

解析：该患者出现月经不调，以及不孕的情况，与任脉相关，任脉的生理功能：调节阴经气血；任主胞胎。患者出现失血过多，与冲脉相关，冲脉的生理功能：调节十二经气血；与女子月经及孕育机能有关（D对）。阴跷脉和阳跷脉（A错）的生理功能：主司下肢运动；司眼睑开合。阴维脉和阳维脉（B错）的生理功能：维系全身经脉。督脉（C错）调节阳经气血；反映脑、髓、肾的技能。